某药厂生产的藿香祛暑胶囊具有祛暑化湿，解表和中功效。其药物组成为广藿香、香薷、白芷、紫苏叶、苍木、丁香、陈皮、大腹皮、法半夏、茯苓、生姜、甘草，辅料为甘油、植物油、明胶、蜂蜡、食用色素。辅料植物油与蜂蜡组成的油蜡混合物是用作软胶囊填充物料的
A. 助溶剂
B. 抗氧剂
C. 增溶剂
D. 吸收剂
E. 助悬剂

正确答案：E。助悬剂

解析：本题考查的是软胶囊的填充物料。辅料植物油与蜂蜡组成的油蜡混合物是用作软胶囊填充物料的助悬剂（E对）。软胶囊对填充物料的要求：软胶囊可填充各种油类或对囊壁无溶解作用的药物溶液或混悬液，也可充填固体药物。填充物料为低分子量水溶性或挥发性有机物（如乙醇、丙酮、羧酸等）或充填药物的含水量超过5%，会使软胶囊溶解或软化；醛类可使囊膜中明胶变性；O/W型乳剂会失水破坏，均不宜作为软胶囊的填充物。填充药物混悬液时，分散介质常用植物油或PEG 400。油状介质常用10%～30%的油蜡混合物作助悬剂，而非油状介质则常用1%～15% PEG 4000或PEG 6000。必要时可加用抗氧剂（B错）、表面活性剂等附加剂。填充液pH应控制在4.5～7.5之间，强酸性可导致明胶水解而泄漏，强碱性可引起明胶变性而影响溶解释放。填充固体药物时，药粉应过五号筛，并混合均匀。助溶剂（A错）：难溶性药物与加入的第三种物质在溶剂中形成可溶性分子间络合物、缔合物或复盐等,以增加药物在溶剂中的溶解度。这第三种物质称为助溶剂。增溶剂（C错）：增溶是指难溶性药物在表面活性剂形成的胶团作用下，在溶剂中溶解度增加并形成溶液的过程。具有增溶作用的表面活性剂称为增溶剂。增溶剂的最适宜亲水亲油平衡值（HLB）为15～18，常用的增溶剂为聚山梨酯、聚氧乙烯脂肪酸酯类等。吸收剂（D错）：为片剂的附加剂，适用于原料药（含中间体）中含有较多挥发油、脂肪油或其他液体，而需制片者。